可用于制备脂质体的是
A. 羟丙基甲基纤维素
B. 单硬脂酸甘油酯
C. 大豆磷脂
D. 无毒聚氯乙烯
E. 乙基纤维素

正确答案：C。大豆磷脂

解析：本题考查脂质体。脂质体的膜材主要由磷脂与胆固醇构成。磷脂包括天然的卵磷脂、脑磷脂、豆磷脂（C对）以及合成磷脂等，均可用作脂质体双分子层基本材料。胆固醇具有调节膜流动性的作用，是脂质体的“流动性缓冲剂”。羟丙甲纤维素（HPMC）（A错）为亲水凝胶骨架材料。单硬脂酸甘油酯（B错）为溶蚀性骨架材料。无毒聚氯乙烯（D错）和乙基纤维素（E错）为不溶性骨架材料。